采取的手术措施是单纯疝囊高位结扎的疝是
A. Richter疝
B. Littre疝
C. 滑动疝
D. 嵌顿性疝
E. 绞窄性疝

正确答案：E。绞窄性疝

解析：绞窄性斜疝因肠坏死而局部有严重感染，通常采取单纯疝囊高位结扎、避免施行修补术，因感染常使修补术失败（E对）。